当氯己定和氟化亚锡联合用于控制菌斑时，正确的使用方法是
A. 应用氯己定后15-20分钟再用氟化亚锡
B. 应用氯己定后90分钟再用氟化亚锡
C. 应用氯己定后5分钟再用氟化亚锡
D. 应用氯己定后6-10分钟再用氟化亚锡
E. 应用氯己定后30-60分钟再用氟化亚锡

正确答案：E。应用氯己定后30-60分钟再用氟化亚锡

解析：本题考查菌斑控制的方法。当氯己定和氟化亚锡联合用于控制菌斑时，正确的使用方法是应用氯己定后30-60分钟再用氟化亚锡（E对）。氯己定又称洗必泰，化学名称为双氯苯双胍己烷，是二价阳离子表面活性剂。常以葡萄糖酸洗必泰的形式使用。氯己定主要用于局部含漱、涂擦和冲洗，也可用含氯己定的凝胶或牙膏刷牙以及用氯己定涂料封闭窝沟。氯己定能较好地抑制龈上菌斑形成和控制龈炎，平均达到60%。使用0.12%或0.2%氯己定液含漱，每天2次，每次10mL，每次1分钟，可减少菌斑45%-61%，龈炎可减少27%-67%。除了抗菌斑与龈炎外，还可用于口内手术之后，预防根面龋及龈下冲洗。当与氟化亚锡一起用于预防项目时，应在用洗必泰液含漱后30-60分钟再用氟化亚锡，以防止作用相互抵消。